下列那项不是引起AG增高型代谢性酸中毒的病因？
A. 糖尿病
B. CO中毒
C. 严重饥饿
D. 肠瘘
E. 水杨酸中毒

正确答案：D。肠瘘

解析：AG增高型代谢性酸中毒常见于固定酸增多的情况。肠瘘（D错，为本题正确答案）导致碳酸氢盐含量高肠液大量丢失引起代谢性酸中毒，由于NaHCO₃属于挥发酸，所以AG不会升高。在糖尿病（A对）和严重饥饿（C对）情况下机体大量动用脂肪供能，大量脂肪酸进入肝，形成过多的酮体（其中β-羟丁酸和乙酰乙酸为固定酸），超过了外周组织的氧化能力及肾排出能力时可发生酮症酸中毒。水杨酸中毒（E对）为大量摄入外源性固定酸后超过机体碳酸氢盐缓冲对的缓冲能力而发生代谢性酸中毒。CO中毒（B对）时由于机体缺氧使细胞内糖的无氧酵解增强而引起乳酸增加，产生乳酸性酸中毒，乳酸也属于固定酸的一种。